2008年修订的《传染病防治法》中新增加的丙类传染病是
A. 艾滋病与钩端螺旋体病
B. 登革热与炭疽
C. 布氏杆菌病与梅毒
D. 手足口病
E. 黑热病与流行性感冒

正确答案：D。手足口病